下列细胞中，不受噬菌体侵袭的是
A. 淋巴细胞
B. 真菌
C. 细菌
D. 螺旋体
E. 支原体

正确答案：A。淋巴细胞

解析：噬菌体是侵袭微生物的病毒，只含有一种核酸DNA或RNA，可感染细菌、真菌、螺旋体和支原体等。掌握“噬菌体性状及分类”知识点。